造成土壤污染后，可持续数十年而不易自净的污染物是
A. 有机磷农药
B. 化肥
C. 重金属
D. 除草剂
E. 硫化物

正确答案：C。重金属

解析：本题考查持续时间长，不易自净的污染物。重金属是指具有较高原子量的金属元素，如铅、镉、汞、铬、铜、锌等，它们是土壤污染的主要污染物之一。重金属（C对ABDE错）具有较高的毒性，其在土壤中的持久性较强，一旦进入土壤，可持续数十年而不易自净。重金属污染的主要来源是工业排放、农药残留、垃圾焚烧等，它们会污染土壤，影响土壤的肥力，并且会对人体健康造成危害。